男，46岁，湖北农民。肝功能反复异常10余年。1个月来出现腹胀，尿黄。查体：面色晦暗，巩膜黄染，见肝掌及蜘蛛痣，腹水征（+）。实验室检查：ALT180U/L，TBil37mol/L，PTA60%，HBsAg（-），抗HCV（-）。肝脏最可能的病理变化是
A. 肝脏呈干线状纤维化，肝脏表面有大小不等的结节
B. 肝细胞水肿，有大量炎症细胞浸润
C. 肝细胞亚大块坏死
D. 肝细胞大块坏死
E. 肝细胞水肿，假小叶形成

正确答案：A。肝脏呈干线状纤维化，肝脏表面有大小不等的结节

解析：患者肝功能反复异常10余年。1个月来出现腹胀，尿黄。查体：面色晦暗，巩膜黄染，见肝掌及蜘蛛痣，腹水征（+）。ALT（谷丙转氨酶，正常值为5-40U/L）、TBil（总胆红素，正常值为3.4-17.1μmol/L）升高，HBsAg（-），抗HCV（-），排除病毒性肝硬化。患者居于血吸虫疫区，职业为农民，考虑血吸虫性肝硬化。血吸虫性肝硬化镜下肝脏呈干线状纤维化，肝脏表面有大小不等的结节（A对）。肝细胞水肿，有大量炎症细胞浸润（B错）、肝细胞亚大块坏死（C错）及肝细胞大块坏死（D错）为急性病理改变，本例为慢性病程。肝细胞水肿，假小叶形成（E错）主要见于坏死后性肝硬化。